某医师治热病邪入心包之高热惊厥、神昏谵语，常用安宫牛黄丸。此因该成药除清热解毒外，又能
A. 豁痰开窍
B. 活血开窍
C. 镇惊开窍
D. 行气开窍
E. 化浊开窍

正确答案：C。镇惊开窍

解析：本题考查的是安宫牛黄丸功效。该成药除清热解毒外，又能镇惊开窍（C对）。安宫牛黄丸（胶囊、散）【功能】清热解毒，镇惊开窍。人工牛黄性效同牛黄，其苦凉清泄，芳香开化，善泻火解毒、豁痰开窍（A错）、定惊。小儿化毒散（胶囊）【方义解释】川贝母甘润辛散，善解毒消肿、活血开郁（B错），故为佐药。参苓白术散（水丸、颗粒）【方义解释】砂仁辛能行散，既行气开胃（D错），使补而不滞；又载诸药上行，以达培土生金之效，故为佐药。复方丹参片（丸、胶囊、滴丸）【方义解释】冰片辛散苦泄，香窜微寒，善通窍止痛、醒神化浊（E错），并引药入心经，故为佐使药。